甲状舌管囊肿发生最多见的部位是
A. 胸锁乳突肌区
B. 下颌角区
C. 甲状舌骨区
D. 上颌中切牙牙槽骨区
E. 鼻底部

正确答案：C。甲状舌骨区

解析：甲状舌管囊肿可发生在舌盲孔与甲状腺之间导管经过的任何部位，以甲状舌骨区发生者最多见。掌握“甲状舌管囊肿”知识点。